可以鉴别上、下尿路感染的依据是
A. 中段尿细菌培养
B. 尿抗体包裹细菌检查
C. 尿细菌定量
D. 3小时尿白细胞计数
E. 尿中脓细胞检查

正确答案：B。尿抗体包裹细菌检查

解析：尿抗体包裹细菌检查阳性者，多为肾盂肾炎，阴性者多为膀胱炎。掌握“急性肾孟肾炎、尿路结石及慢性肾衰竭”知识点。